男性，75岁，左侧腹股沟肿块3天，绞痛2天，查体：左侧腹股沟可触及包块，呈半球形，按压可还纳，后又复出，诊断是
A. 腹股沟斜疝
B. 股疝
C. 腹股沟直疝
D. 切口疝
E. 脂肪瘤

正确答案：C。腹股沟直疝

解析：男性，75岁，左侧腹股沟肿块3天，绞痛2天，查体：左侧腹股沟可触及包块，呈半球形，按压可还纳，后又复出，结合患者的表现，诊断是腹股沟直疝（C对）。